患者男性，35岁.泄泻20余年，诊断为溃疡性结肠炎。稍进油腻或生冷之品，则大便次数增多，水谷不化，脘腹胀闷不舒，面色萎黄，肢倦乏力，纳食减少，舌淡苔白，脉细弱。其治疗首选
A. 白头翁汤
B. 参苓白术散
C. 胃苓汤
D. 痛泻要方
E. 驻车丸

正确答案：B。参苓白术散

解析：患者为中年男性，泄泻病史20余年，因饮食不慎可出现大便次数增多，水谷不化，脘腹胀闷不舒，面色萎黄肢倦乏力，纳食减少，舌淡苔白，脉细弱故其治疗首选参苓白术散（B对）。白头翁汤功效清热解毒，凉血止痢，主治热毒痢疾（A错）。胃苓汤功效祛湿和胃，行气利水，主治夏秋之间，脾胃伤冷，水谷不分，泄泻如水，以及水肿、腹胀、小便不利者（C错）。痛泻药方功效补脾柔肝，祛湿止泻，主治脾虚肝郁之痛泻（D错）。驻车丸功效清热燥湿，养阴止痢，主治久痢赤白，休息痢（E错）。